女性，30岁。左腰部受伤后出现腰痛和镜下血尿，生命体征稳定，应考虑
A. 肾挫伤
B. 肾部分裂伤
C. 肾盂裂伤
D. 肾实质全层裂伤
E. 肾蒂损伤

正确答案：A。肾挫伤

解析：青年女性，左腰部受伤（提示可能有肾脏损伤）后，出现腰痛和镜下血尿（肾损伤表现），生命体征稳定（提示患者症状较轻），结合患者病史和临床表现，应考虑左肾挫伤（A对）。肾部分裂伤（B错）、肾全层裂伤（D错）均会出现明显血尿，腰腹部可触及肿块；肾蒂损伤（E错）可迅速出现血尿、休克等表现，病情危急；肾盂裂伤（C错）可导致尿液外渗进入腹腔时，可出现腹膜刺激症状。